羟基茜草素属于
A. 苯醌
B. 萘醌
C. 菲醌
D. 蒽醌
E. 三萜

正确答案：D。蒽醌

解析：本题考查的是羟基茜草素素分类。羟基茜草素属于蒽醌（D对）。茜草素型：这类蒽醌其羟基分布在一侧苯环上，颜色为橙黄至橙红色，种类较少，如中药茜草中的茜草素及其苷、羟基茜草素、伪羟基茜草素。醌类化合物从结构上分主要有苯醌、萘醌、菲醌、蒽醌等四类。1.苯醌（A错）类：苯醌类化合物从结构上可分为邻苯醌和对苯醌两大类。从中药软紫草中分得的一些物质属于对苯醌类化合物。2.萘醌（B错）类：许多萘醌类化合物具有明显的生物活性，如从中药紫草及软紫草中分得的一系列紫草素及异紫草素衍生物，可认为这些萘醌化合物为紫草的有效素成分。3.菲醌（C错）类：天然菲醌类衍生物包括邻醌及对醌两种类型。如从中药丹参根中提取的丹参醌Ⅰ、丹参醌ⅡA、丹参醌ⅡB、隐丹参醌等。4.蒽醌类：蒽醌类成分包括蒽酮及其不同还原程度的产物。按母核可分为单蒽核及双蒽核，按氧化程度又可分为氧化蒽酚、蒽酮、蒽酚及蒽酮的二聚物。三萜（E错）是由6个异戊二烯单位衍生而成，不属于醌类化合物。